DNA复制过程中，母链遗传信息必须准确地传到子链，即复制的保真性，下列哪种情况可造成复制的失真
A. A与T、G与C配对
B. DNA聚合酶选择配对碱基
C. DNA聚合酶即时校读
D. DNA聚合酶依赖模板
E. DNA聚合酶亚缺乏ε亚基

正确答案：E。DNA聚合酶亚缺乏ε亚基